幼儿机体正处于生长发育的过程中，脏腑、筋骨、津液等均柔弱不足，关于幼儿患儿合理用药的说法，正确的是
A. 小儿脏腑娇嫩，用药不宜过早，处方要精，用量要轻
B. 小儿脾气不足，用药应佐健脾和胃消食导滞之品
C. 小儿外有表邪内有火热，用药以苦寒清热为主，避免热邪伤津
D. 小儿纯阳之体，外感病邪易出现惊风，用药应以平肝息风为主
E. 小儿生机旺盛，易营养不足，应注意及时予以滋补之品

正确答案：B。小儿脾气不足，用药应佐健脾和胃消食导滞之品

解析：本题考查的是婴幼儿患者合理应用中药的原则。幼儿机体正处于生长发育的过程中，脏腑、筋骨、津液等均柔弱不足，关于幼儿患儿合理用药的说法，正确的是小儿脾气不足，用药应佐健脾和胃消食导滞之品（B对）。婴幼儿患者合理应用中药的原则：婴幼儿机体正处于生长发育的过程之中，不论在肌肤、脏腑、筋骨、津液等方面，均柔弱不足。在这个时期，许多器官和组织尚未发育成熟，新陈代谢旺盛，吸收、排泄都比较快，对药物敏感性强。由于中药疗效好、副作用小，许多小儿常见病、疑难病中医中药疗效独特，因此现代临床对中医中药治疗小儿常见病、疑难病应用颇多。用药原则有以下几点。1.用药及时，用量宜轻：小儿得病急，变化快，因此用药要及时。小儿脏腑娇嫩，对药敏感，处方要精，用量要轻（A错）。2.宜用轻清之品：小儿脏气清灵，对大苦、大辛、大寒、大热、攻伐和药性猛烈的药物要慎用（C错）。若为风热表证，当以辛凉解散表邪，以银翘散、桑菊饮为主。对外有表邪，内有火热之发热，仍以辛凉解表。顺其大热之势清而扬之，不宜用苦寒退热之品，以免闭遏邪气于里，攻伐正气；如属必用，则宜少量，中病即止。3.宜佐健脾和胃之品：小儿脾气不足，消化能力差，因此应佐以健脾和胃，消食导滞之山药、山楂、陈皮、六神曲、麦芽、鸡内金、白术等。4.宜佐凉肝定惊之品：小儿体属“纯阳”，热病偏多，且肝常有余，易出现肝热抽搐、惊风之症。救治小儿疾病特别是外感病邪，出现壮热、烦躁、惊惕等症，则应在清热透解之时，佐以平肝息风之蝉蜕、钩藤、僵蚕、地龙等（D错）。5.不宜滥用滋补之品：小儿生机旺盛，宜饮食调理，不宜滥用滋补之品（E错），否则会使机体阴阳失衡，伤及脏腑气机。过用或滥用滋补药，常常引起相关不良反应，如过服人参会引起人参滥用综合征，过服阿胶会引起火气亢盛的症状等。